十二经脉中循行于腹部的经脉，自内向外的顺序是
A. 足阳明足太阴足厥阴足少阴
B. 足少阴足阳明足太阴足厥阴
C. 足少阴足阳明足厥阴足太阴
D. 足太阴足阳明足少阴足厥阴
E. 足阳明足少阴足太阴足厥阴

正确答案：B。足少阴足阳明足太阴足厥阴

解析：十二经脉在躯干部的分布规律：①手三阴经均从胸部行至腋下；手三阳经行于肩和肩胛部。②足三阳经自上而下走行，则阳明经行于前（胸腹面），太阳经行于后（背腰面），少阳经行于躯体两侧。足三阴经自下而上均行于腹胸面。③十二经脉在腹胸部的分布规律，自内向外依次为足少阴肾经、足阳明胃经、足太阴脾经和足厥阴肝经（B对）。可简记为“肾胃脾肝腹内外”。